糖皮质激素不具有哪种药理作用
A. 快速强大的抗炎作用
B. 抑制细胞免疫和体液免疫
C. 提高机体对细菌内毒素的耐受力
D. 提高机体对细菌外毒素的耐受力
E. 增加血中白细胞数量，但却抑制其功能

正确答案：D。提高机体对细菌外毒素的耐受力